医患交往障碍在医生方面的原因可能是
A. 医疗技术不过硬
B. 只看病不看人
C. 以科研价值衡量病人
D. 以物质利益确定医患关系
E. 以上都是

正确答案：E。以上都是